在胸部，经脉由中间向两旁的排列顺序依次是
A. 任脉、胃经、心经、脾经
B. 任脉、肾经、胃经、脾经
C. 任脉、心经、肾经、肝经
D. 任脉、肾经、胃经、肝经
E. 任脉、胃经、肾经、脾经

正确答案：B。任脉、肾经、胃经、脾经

解析：在胸部，经脉由中间向两旁的排列顺序依次是：任脉、肾经、胃经、脾经、肝经（B对E错）；心经（AC错）循行在上肢内侧后缘，不在胸部分布；胃经、肾经、脾经（D错）的顺序相较于B不是最优选项。